盐酸四环素的检查项目有
A. 聚合物
B. 生育酚
C. 酮体
D. 有关物质
E. 杂质吸光度

正确答案：D、E。有关物质；杂质吸光度